女，47岁，慢性肾炎病史多年，近2年经常出现双下肢浮肿，一直服潘生丁及氢氯噻嗪治疗。近一周感觉腹胀，双下肢无力，首先考虑的是
A. 肾功能严重減退
B. 低钾血症
C. 高血压
D. 酸中毒
E. 药物中毒

正确答案：B。低钾血症

解析：患者因慢性肾炎双下肢水肿长期服用潘生丁（非硝酸酯类冠状动脉扩张剂）及氢氯噻嗪治疗。氢氯噻嗪作用于肾远曲小管近端和髓袢升支远端，抑制钠和钾的重吸收，长期服用易引起低钾血症。低钾血症可致骨骼肌及胃肠道平滑肌细胞超极化阻滞、兴奋性降低，引起骨骼肌无力和发作性软瘫、肠蠕动减慢，可表现为食欲缺乏、腹胀、恶心和便秘。因此本例患者应首先考虑诊断为低钾血症（B对）。慢性肾炎进展至肾功能严重減退（A错）多为一慢性过程，常出现的水电解质紊乱为高钾血症，表现为神经肌肉兴奋性升高所导致的肌肉抽搐、痉挛及肠道运动增强。高血压（C错）表现为血压升高，常见症状有头晕、头痛、颈板发紧、疲劳、心悸等，一般无腹胀、双下肢无力。酸中毒（D错）多表现为恶心、呕吐、呼吸深快、头痛、嗜睡、甚至昏迷。低钾血症为长期服用利尿剂产生的副作用，而非利尿剂药物中毒（E错）的表现。